对军团菌感染效果最好的药物是
A. 林可霉素
B. 红霉素
C. 庆大霉素
D. 万古霉素
E. 多黏菌素

正确答案：B。红霉素

解析：红霉素（B对）属于大环内脂类抗生素，不可逆地结合到细菌核蛋白体50S亚基的靶位上，选择性抑制细菌蛋白质合成，抗菌作用强，临床用于青霉素过敏或对青霉素耐药的革兰阳性菌如金黄色葡萄球菌、肺炎球菌和其他链球菌引起的感染，为军团菌的首选药。林可霉素（A错）首选用于金黄色葡萄球菌引起的骨髓炎，可用于革兰阳性菌敏感菌引起的感染如咽喉炎、中耳炎、肺炎、心内膜炎、败血症等，可作为青霉素过敏的替代药物，还用于厌氧菌引起的腹膜炎、盆腔感染、脓肿等。庆大霉素（C错）抗菌范围广，抗菌活性强，为治疗各种革兰阴性杆菌感染的主要抗菌药，尤其对沙雷菌属作用更强。万古霉素（D错）抗菌谱窄，临床用于耐药的革兰阳性菌引起的严重感染，尤其是耐甲氧西林金黄色葡萄球菌和耐青霉素肠球菌所致的严重感染。多黏菌素（E对）的化学结构类似阳离子表面活性剂，能破坏革兰阴性菌的外膜结构并使其通透性增加，细菌内成分外漏，导致细菌死亡，临床用于耐药或难以控制的革兰阴性菌引起的感染，如脑膜炎、败血症等。